属于α－葡萄糖甘酶抑制剂的是
A. 阿卡波糖
B. 二甲双胍
C. 罗格列酮
D. 西格列汀
E. 格列吡嗪

正确答案：A。阿卡波糖

解析：本题考查阿卡波糖。阿卡波糖（A对）为α-葡萄糖甘酶抑制剂，通过竞争性抑制双糖类水解酶α-葡萄糖甘酶的活性而减慢淀粉等多糖分解为双糖和单糖，延缓单糖的吸收。二甲双胍（B错）为双胍类药，可增加基础状态下糖的无氧酵解，抑制肠道内葡萄糖的吸收，减少糖原生成和肝糖输出。罗格列酮（C错）属于胰岛素增敏剂。西格列汀（D错）为二肽基肽酶-4抑制剂。格列吡嗪（E错）为磺酰脲类促胰岛素分泌药，通过刺激胰岛B细胞分泌胰岛素，增加体内的胰岛素水平而降低血糖。